利尿药初期降压机制可能是
A. 降低血管对缩血管剂的反应性
B. 增加血管对扩血管剂的反应性
C. 降低动脉壁细胞的Na+含量
D. 排钠利尿，降低胞外液及血容量
E. 诱导动脉壁产生扩血管物质

正确答案：D。排钠利尿，降低胞外液及血容量

解析：各类利尿药单用即有降压作用，并可增强其他降压药的作用。用药初期，利尿药可减少细胞外液容量及心输出量。利尿药长期使用可降低血管阻力，但该作用并非直接作用，最可能的机制是持续地降低体内Na+浓度及降低细胞外液容量。平滑肌细胞内Na+浓度降低可能导致细胞内Ca2+浓度降低，从而使血管平滑肌对缩血管物质的反应性减弱。掌握“抗高血压药”知识点。